滴定分析指示剂有
A. 溴化钾
B. 甲基红
C. 氯化钠
D. 结晶紫
E. 酚酞

正确答案：B、D、E。甲基红；结晶紫；酚酞

解析：本题考查酸碱滴定法。滴定分析指示剂有甲基红（B对）、结晶紫（D对）、酚酞（E对）。甲基红、酚酞、溴酚蓝、甲基橙可作酸碱指示剂。结晶紫是非水碱量法的指示剂。溴酸钾可做氧化还原滴定法的指示剂。溴化钾（A错）、氯化钠（C错）均不能作指示剂。